易破裂出血的豆纹动脉发自
A. 大脑前动脉
B. 大脑中动脉
C. 大脑后动脉
D. 椎动脉
E. 后交通动脉

正确答案：B。大脑中动脉

解析：豆纹动脉是由大脑中动脉（B对）发出的细小的中央支。其行程呈S形弯曲，因血流动力关系，在高血压动脉硬化时容易破裂（故又称出血动脉），导致脑出血，出现严重的功能障碍。